国家药品标准的内容有
A. 性状
B. 鉴别
C. 检查
D. 含量测定
E. 贮藏

正确答案：A、B、C、D、E。性状；鉴别；检查；含量测定；贮藏

解析：本题考查药品标准。国家药品标准的内容有性状（A对）、鉴别（B对）、检查（C对）、含量测定（D对）、贮藏（E对）。《中国药典》正文标准，以二部收载品种标准为例，收载的16项内容可分为三部分：①定义：涵盖药品的一般信息，包括品名、有机药物的结构式、分子式与分子量、来源或有机药物的化学名称、含量或效价的限度规定、处方、制法；②技术规格：为药品标准的主体，列有药品的质量要求与检测方法，内容包括性状、鉴别、检查、含量测定；③附加事项：是为药品的临床合理使用与贮藏提供必要的信息与要求，主要包括类别、规格、贮藏、杂质信息等。